患者，男，65岁，糖尿病病史5年，因咳嗽、打喷嚏鼻塞症状就诊，医师处方维C银翘片和酚麻美敏片。该处方存在的问题是
A. 超适应证用药
B. 剂型选用不合理
C. 存在有风险的药物相互作用
D. 有用药禁忌症
E. 重复用药

正确答案：E。重复用药

解析：本题考查重复用药。题干中处方存在的问题是重复用药（E对）。两种药物中均含有对乙酰氨基酚、马来酸氯苯那敏，故该处方存在重复用药问题。超适应证用药（A错）是指超出药品说明书所标明的适应证范围而用药的行为。该处方没有剂型选用不合理（B错）以及存在有风险的药物相互作用（C错）的问题。用药禁忌（D错）可分为中药用药禁忌和西药用药禁忌，中药用药禁忌包括中药配伍禁忌、妊娠用药禁忌、服药时的饮食禁忌等；西药用药禁忌包括妊娠期用药禁忌、儿童用药禁忌、运动员用药禁忌等。